利用热能除去湿物料中水分或其它溶剂的过程
A. 传热过程
B. 传质过程
C. 干燥过程
D. 辐射干燥
E. 介电加热于燥

正确答案：C。干燥过程